患者，右下6死髓牙，经根管治疗后以金属烤瓷冠修复，在牙体预备取模后至金属烤瓷冠初戴之间，尚需
A. 用金属全冠作保护性修复
B. 用塑料全冠作保护性修复
C. 制作间隙保护器
D. 不作任何处理
E. 用牙龈保护剂保护牙龈

正确答案：B。用塑料全冠作保护性修复

解析：本题考查暂时冠的作用。患牙金属烤瓷冠修复，在牙体预备取模后至金属烤瓷冠初戴，若不作任何处理（D错），由于余留牙体组织少且根管治疗后牙体组织较脆，易发生牙体组织损伤，以及对颌牙伸长等症状，因此需用塑料全冠行作保护性修复（B对）以保护和稳定牙列，防止对颌牙伸长，恢复部分咬合功能。制作间隙保持器（C错）仅可单纯维护缺失牙间隙，不能对牙列进行保护，以及恢复咬合功能，金属全冠（A错）为永久性修复，牙龈保护剂（E错）用于牙龈切除术后。